制备维生素C注射剂时，加入的亚硫酸氢钠是作为
A. 防腐剂
B. 矫味剂
C. 乳化剂
D. 抗氧剂
E. 助悬剂

正确答案：D。抗氧剂

解析：本题考查注射剂常用附加剂。维生素C注射液处方分析：维生素C-主药；依地酸二钠-金属螯合剂；碳酸氢钠-pH调节剂；亚硫酸氢钠-抗氧剂（D对）；注射用水-溶剂。此处方中无防腐剂（A错）、矫味剂（B错）、乳化剂（C错）和助悬剂（E错）。